下列哪一项是根尖周囊肿组织病理学表现
A. 囊壁外层为疏松结缔组织
B. 炎性浸润细胞主要为淋巴细胞、浆细胞
C. 根尖部牙槽骨完好
D. 上皮钉突因炎性刺激发生规则增生
E. 中央囊腔有部分脓液

正确答案：B。炎性浸润细胞主要为淋巴细胞、浆细胞

解析：本题考查根尖周囊肿的组织病理学表现。根尖周囊肿由纤维结缔组织囊壁包绕（A错），炎性浸润细胞主要为淋巴细胞、浆细胞（B对），较大囊肿常导致唇颊侧骨壁吸收变薄（C错），上皮钉突因炎症刺激发生不规则增生（D错），增殖上皮团块中央液化、囊性变（E错）。